中小学生健康教育的第一目标人群是
A. 中小学生
B. 教职员工
C. 学校领导
D. 社区人群
E. 学生家长

正确答案：A。中小学生